对三叉神经痛采用封闭疗法使用的药物是
A. 利多卡因
B. 丁卡因
C. 普鲁卡因
D. 卡马西平
E. 维生素B₁₂

正确答案：A。利多卡因

解析：本题考查注射治疗-封闭疗法。对三叉神经痛采用封闭疗法使用的药物是利多卡因（A对）。1.封闭疗法是用1%～2%利多卡因行疼痛神经支的阻滞麻醉，也可加人维生素B₁₂做神经干封闭，每日1次，10次为1个疗程。2.对原发性三叉神经痛均应首先采用药物治疗，如卡马西平（D错）、奥卡西平、苯妥英钠、氯硝西泮等。